医师的行为规范除外
A. 尊重科学，严格权限
B. 规范行医，规范试验
C. 重视人文，救死扶伤
D. 规范文书，严格报告
E. 严谨求实，防止差错

正确答案：E。严谨求实，防止差错